17222-2012）要求：中学生除体育课、早操、课间操外，每周参加课外体育活动不宜少于几次
A. 1次
B. 2次
C. 3次
D. 4次
E. 5次

正确答案：C。3次